常见细菌性食物中毒是
A. 沙门菌食物中毒
B. 变形杆菌食物中毒
C. 副溶血性弧菌食物中毒
D. 葡萄球菌肠毒素食物中毒
E. 以上均正确

正确答案：E。以上均正确

解析：常见细菌性食物中毒：①沙门菌食物中毒；②副溶血性弧菌食物中毒；③葡萄球菌肠毒素食物中毒；④变形杆菌食物中毒。掌握“食品安全”知识点。